治疗先天性水疝，应首选
A. 济生肾气丸
B. 大分清饮
C. 加味五苓散
D. 宝鉴当归四逆汤
E. 活血散瘀汤加味

正确答案：A。济生肾气丸

解析：水疝是指阴囊内有水湿停滞，不红不热，状如水晶为特征的病症，肝寒不疏，脾虚不运，肾虚失约，或先天禀赋不足，外伤络阻，水液不行都可引起，肾为水脏且为先天之本，济生肾气丸可温补肾阳，肾阳气充足，则水液输布正常，适于先天禀赋不足的水疝（A对）。大分清饮功能清热利湿通淋，适于湿热下注的水疝（B错）。加味五苓散具有利湿行水之功效，适于寒凉伤脏，而为呕吐、泻利、腹痛等病症（C错）。宝鉴当归四逆汤具有温经散寒，养血通脉之功效，适于疝气，症见脐腹冷痛相引腰胯而痛（D错）。活血散瘀汤善于活血散瘀，适于由外伤导致瘀血阻络的水疝（E错）。